医疗机构及其工作人员拒绝对送诊的疑似精神障碍患者作出诊断，情节严重的可以责令有关医务人员
A. 暂停1个月以上3个月以下执业活动
B. 暂停3个月以上6个月以下执业活动
C. 暂停1个月以上6个月以下执业活动
D. 暂停6个月执业活动
E. 暂停6个月以上12个月以下执业活动

正确答案：C。暂停1个月以上6个月以下执业活动

解析：医疗机构及其工作人员有下列行为之一的，由县级以上人民政府卫生行政部门责令改正，给予警告；情节严重的，对直接负责的主管人员和其他直接责任人员依法给予或者责令给予降低岗位等级或者撤职、开除的处分，并可以责令有关医务人员暂停1个月以上6个月以下执业活动：①拒绝对送诊的疑似精神障碍患者作出诊断的；②对依照《精神卫生法》规定实施住院治疗的患者未及时进行检查评估或者未根据评估结果作出处理的。掌握“精神障碍康复及法律责任”知识点。